治疗小儿口疮风热乘脾证宜选用
A. 凉膈散
B. 泻黄散
C. 清热泻脾散
D. 泻心导赤散
E. 六味地黄丸

正确答案：A。凉膈散

解析：疱疹性口炎风热乘脾证，是由邪热内积心脾，心火上炎所致，治以疏风清热，泻火解毒，方药为凉膈散（A对）。泻黄散（B错）其功用为泻脾胃伏火，适用于脾胃伏火证。清热泻脾散（C错）其功用为清脾泄热，使用于心脾蕴热之鹅口疮。泻心导赤散（D错）其功用为清心泻火，适用于鹅口疮之心火上炎证。六味地黄丸（E错）其功用为滋阴补肾，可用于鹅口疮之虚火上浮证。